变应性接触性皮炎是属于
A. 抗原抗体结合反应
B. 细胞毒反应
C. T细胞介导的迟发型变态反应
D. 速发型变态反应
E. 自身免疫反应

正确答案：C。T细胞介导的迟发型变态反应

解析：本题考查变应性接触性皮炎。变应性接触性皮炎是化妆品中含有变应原物质，可刺激机体免疫系统产生以T细胞介导的皮肤迟发型变态反应性组织损伤（C对ABDE错）。